慢性膀胱刺激症状患者，静脉尿路造影见右肾上盏有破坏，可能是诊断为
A. 右肾肿瘤
B. 右肾盂肾炎
C. 右肾炎
D. 右肾结核
E. 右肾乳头炎

正确答案：D。右肾结核

解析：慢性膀胱刺激症状（提示可能有泌尿系感染）患者，静脉尿路造影见右肾上盏有破坏（肾结核的早期表现），结合患者临床表现和相关检查，最可能的诊断是右肾结核（D对）。肾肿瘤（A错）主要表现为肉眼血尿、腰部疼痛及腹部肿块，晚期可有膀胱刺激症状，静脉尿路造影可见肾盏肾盂出现不规则变形、狭窄、拉长、移位或充盈缺损。肾盂肾炎（B错）、肾乳头炎（E错）为细菌性炎症，主要表现为寒战、高热等脓毒症症状及患侧腰痛，可伴有膀胱刺激征。肾炎（C错）主要表现为血尿、蛋白尿、水肿和高血压，可伴一过性氮质血症。